菟丝子散治疗小儿遗尿的证是
A. 肺脾气虚证
B. 肾气不足证
C. 肝经湿热证
D. 心肾不交证
E. 痰瘀阻滞证

正确答案：B。肾气不足证

解析：菟丝子散能温补固涩，主治肾阳不足，下焦虚冷，小便多或不禁，菟丝子散所治的小儿遗尿应是肾气不足证（B对）。肺脾气虚证方选补中益气汤合缩泉丸加减（A错）。肝经湿热证方选龙胆泻肝汤加减（C错）。心肾失交证方选交泰丸合导赤散加减（D错）。痰瘀阻滞证不是小儿遗尿的证型（E错）。